女性青春早期是指
A. 身高生长发育刚刚开始的阶段
B. 身高生长减缓而性腺发育接近成熟阶段
C. 女孩月经初潮前的生长突增阶段
D. 月经初潮后的生长发育阶段
E. 第二性征发育近似成人阶段

正确答案：C。女孩月经初潮前的生长突增阶段

解析：本题考查女性青春早期的相关内容。女性的青春早期是指在月经初潮前的体格生长发育突增阶段（C对ABDE错），伴随性器官和第二性征开始发育。